根据药品管理法律法规及相关文件的规定，应当在指定的药品零售企业销售，一般每张处方不得超过7日常用量的是
A. 血液制品
B. 第二类精神药品
C. 含麻黄碱类复方制剂
D. 第一类精神药品

正确答案：B。第二类精神药品

解析：本题考查麻醉药品和精神药品零售规定。根据药品管理法律法规及相关文件的规定，应当在指定的药品零售企业销售，一般每张处方不得超过7日常用量的是第二类精神药品（B对）。第二类精神药品零售企业应当凭执业医师开具的处方，按规定剂量销售第二类精神药品。第二类精神药品一般每张处方不得超过7日常用量。血液制品（A错）不属于药品零售企业经营范围。药品零售企业销售含麻黄碱类复方制剂，应当查验购买者的身份证，并对其姓名和身份证号码予以登记。除处方药按处方剂量销售外，一次销售不得超过2个最小包装（C错）。麻醉药品和第一类精神药品（D错）不得零售。